下列解表药中，兼有化湿功效的是
A. 紫苏
B. 香薷
C. 生姜
D. 白芷
E. 防风

正确答案：B。香薷

解析：香薷辛温发散，入肺经能发汗解表而散寒；其气芳香，入脾胃能化湿和中（B对）。紫苏（A错）的功效解表散寒，行气和胃。生姜（C错）的功效解表散寒，温中止呕，化痰止咳，解鱼蟹毒。白芷（D错）的功效解表散寒，祛风止痛，宣通鼻窍，燥湿止带，消肿排脓。防风（E错）的功效祛风解表，胜湿止痛，止痉。